男孩，8岁，孤独症患者。心理治疗师在对其进行治疗的过程中，每当了解到他有主动向老师问好、递给小朋友玩具或整理好自己的衣服等情形时，就奖励他一个纸质小星星作为强化物。该心理治疗师采用的行为治疗技术是
A. 自我管理
B. 代币疗法
C. 系统脱敏
D. 满灌疗法
E. 差别强化

正确答案：B。代币疗法

解析：代币法是行为疗法中运用最广泛的方法之一，也称表征性奖励制。用奖励强化所期望的行为，用惩罚消除不良行为而达到目的。代币法主要运用代币并编制一套相应的激励系统来对符合要求的目标行为的表现进行肯定和奖励。代币起着表征的作用，只是一个符号，在小学里尤其是以小红花，五角星等等为代表，也可以是记分卡、点数等等，可以根据情况灵活运用。本题中，心理治疗师在孤独症患儿表现所期望行为时，用纸质小星星进行奖励属于典型的代币疗法（B对）。自我管理（A错）就是指个体对自己本身，对自己的目标、思想、心理和行为等等表现进行的管理，自己把自己组织起来，自己管理自己，自己约束自己，自己激励自己，自己管理自己的事务，最终实现自我奋斗目标的一个过程。系统脱敏疗法（C错）是诱导求治者缓慢地暴露出导致神经症焦虑、恐惧的情境，并通过心理的放松状态来对抗这种焦虑情绪，从而达到消除焦虑或恐惧的目的。满灌疗法（D错）也称暴露疗法或冲击疗法，它与系统脱敏疗法正好相反。满灌疗法不需要进行任何放松训练，而一下子呈现最强烈的恐怖、焦虑刺激（冲击）或一下子呈现大量的恐怖、焦虑刺激（满灌、泛滥），以迅速校正病人对恐怖、焦虑刺激的错误认识，并消除由这种刺激引发的习惯性恐怖、焦虑反应。差别强化法（E错）是在理想行为出现时给予奖励刺激，在不理想行为出现时，扣除原先的奖励刺激，可以增强或维持理想的行为，同时减弱或消除不理想的行为，其目的是强化正性行为，消除负性行为。